下列选项不属于大气污染物对人体的间接危害的是
A. 温室效应
B. 臭氧层破坏
C. 酸雨
D. 影响小气候和太阳辐射
E. 致癌、致畸作用

正确答案：E。致癌、致畸作用

解析：本题考查大气污染物对人体的间接危害。大气污染物对人体的间接危害包括温室效应（A对）、臭氧层破坏（B对）、酸雨（C对）、影响小气候和太阳辐射（D对）等。致癌、致畸作用（E错，为本题正确答案）属于大气污染物对人体的直接危害中慢性危害的一种。